患者，男，24岁。近3年来反复餐后3—4小时上腹痛，持续至下次进餐后才缓解。应首先考虑的是
A. 消化性溃疡
B. 胃癌
C. 慢性胃炎
D. 胃肠神经官能症
E. 胆囊炎

正确答案：A。消化性溃疡

解析：本例患者为青年男性，反复餐后上腹痛3年，进餐可缓解，诊断首先考虑为消化性溃疡（A对）。胃癌（B错）好发于中老年人，早期胃癌症状不明显，进展期胃癌可有腹痛、厌食、食欲减低等表现。慢性胃炎（C错）的主要临床表现为无规律性上腹痛。胃肠神经官能症（D错）表现为慢性或反复发作的胃肠道症状如腹泻、腹痛等，胃肠道无器质性改变。胆囊炎（E错）患者的主要临床表现为阵发性右上腹绞痛，疼痛可放射至右肩、肩胛和背部，可有胆囊点压痛和墨菲氏征阳性。